具有杀菌作用的紫外线波长是
A. 50～90nm
B. 100～140nm
C. 150～190nm
D. 200～300nm
E. 400～490nm

正确答案：D。200～300nm